治疗伴有消化性溃疡的高血压药物首选的药物是
A. 硝酸甘油
B. 可乐定
C. 硝苯地平
D. 卡托普利
E. 维拉帕米

正确答案：B。可乐定

解析：可乐定用于治疗中度高血压，适用于兼有溃疡病的高血压及肾性高血压患者（B对）。硝酸甘油适用于治疗各种类型的心绞痛，其中对于稳定型心绞痛为首选药（A错）。硝苯地平可用于轻、中、重各型高血压，对高血压伴有心绞痛、糖尿病、脑血管病、肾功能不良等并发症疗效好（C错）。卡托普利适用于各种类型高血压，对原发性高血压和肾性高血压较好，尤其适用于伴有慢性心功能不全、缺血性心脏病或糖尿病所致肾病的高血压病人（D错）。用于稳定型和不稳定型心绞痛，对伴有心律失常的心绞痛患者尤其适用（E错）。